有关慢性化脓性骨髓炎不恰当的是
A. 可伴有开口受限
B. 毒力弱的细菌感染引起
C. 来自于急性骨髓炎治疗不当
D. 表现不同程度的疼痛和肿胀
E. X线显示溶骨性破坏或穿凿性破坏

正确答案：E。X线显示溶骨性破坏或穿凿性破坏

解析：慢性化脓性骨髓炎：可来自于急性骨髓炎治疗不当，或由毒力弱的细菌感染引起。下颌磨牙区好发，患部可表现不同程度的疼痛和肿胀。相应的面部有炎症浸润、瘘管流脓，可伴有不同程度的开口受限。如果死骨形成广泛，可导致病理性骨折。X线表现为虫蚀状骨吸收，有局灶性阻射影。伴有骨新生时，则有骨硬化的表现。掌握“急慢性化脓性颌骨骨髓炎”知识点。